根据《抗菌药物临床应用管理办法》，下列关于抗菌药物临床应用管理的说法正确的是
A. 具有高级专业技术职务资格的医师方可具有限制使用级抗菌药物处方权
B. 基层医疗机构的药师必须由所在单位组织考核，合格者授予抗菌药物调剂资格
C. 严格控制特殊使用级抗菌药物使用，特殊使用级抗菌药物不得在门诊使用
D. 医疗机构应当根据临床微生物标本检测结果合理选用，不得经验用药

正确答案：C。严格控制特殊使用级抗菌药物使用，特殊使用级抗菌药物不得在门诊使用

解析：本题考查的是抗菌药物应用管理。根据《抗菌药物临床应用管理办法》，下列关于抗菌药物临床应用管理的说法正确的是严格控制特殊使用级抗菌药物使用，特殊使用级抗菌药物不得在门诊使用（C对）。抗菌药物的应用监测：医疗机构和医务人员应当严格掌握使用抗菌药物预防感染的指征。预防感染、治疗轻度或者局部感染应当首选非限制使用级抗菌药物；严重感染、免疫功能低下合并感染或者病原菌只对限制使用级抗菌药物敏感时，方可选用限制使用级抗菌药物；特殊使用级抗菌药物不得在门诊使用，临床应用特殊使用级抗菌药物应当严格掌握用药指征，经抗菌药物管理工作组指定的专业技术人员会诊同意后，由具有相应处方权医师开具处方。特殊使用级抗菌药物会诊人员由具有抗菌药物临床应用经验的感染性疾病科、呼吸科、重症医学科、微生物检验科、药学部门等具有高级专业技术职务任职资格的医师、药师或具有高级专业技术职务任职资格的抗菌药物专业临床药师担任。抗菌药物处方权、调剂资格的授予：具有高级专业技术职务任职资格的医师，可授予特殊使用级抗菌药物处方权（A错）；具有中级以上专业技术职务任职资格的医师，可授予限制使用级抗菌药物处方权；具有初级专业技术职务任职资格的医师，在乡、民族乡、镇、村的医疗机构独立从事一般执业活动的执业助理医师以及乡村医生，可授予非限制使用级抗菌药物处方权。药师经培训并考核合格后，方可获得抗菌药物调剂资格。二级以上医院应当定期对医师和药师进行抗菌药物临床应用知识和规范化管理的培训。医师经本医疗机构培训并考核合格后，方可获得相应的处方权。其他医疗机构依法享有处方权的医师、乡村医生和从事处方调剂工作的药师，由县级以上地方卫生行政部门组织相关培训、考核。经考核合格的，授予相应的抗菌药物处方权或者抗菌药物调剂资格（B错）。《抗菌药物临床应用管理办法》第三章抗菌药物临床应用管理：第三十一条医疗机构应当根据临床微生物标本检测结果合理选用抗菌药物。临床微生物标本检测结果未出具前，医疗机构可以根据当地和本机构细菌耐药监测情况经验选用抗菌药物（D错），临床微生物标本检测结果出具后根据检测结果进行相应调整。